急性乳腺炎的首发症状为
A. 局部硬块
B. 发热
C. 搏动性疼痛
D. 患侧腋窝淋巴结肿大
E. 乳房肿胀疼痛

正确答案：E。乳房肿胀疼痛